为髓室伸向牙尖突出成角形的部分，其形状、位置与牙尖外形相似的是
A. 髓室顶
B. 髓室底
C. 髓室高度
D. 根管口
E. 髓角

正确答案：E。髓角

解析：髓角为髓室伸向牙尖突出成角形的部分，其形状、位置与牙尖外形相似。掌握“髓腔各部分名称、增龄性变化及临床意义”知识点。